骨肉瘤血清增高的是
A. 碱性磷酸酶
B. 癌胚抗原
C. 乳酸脱氢酶
D. α-酸性糖蛋白
E. α-胚胎抗原

正确答案：A。碱性磷酸酶

解析：碱性磷酸酶（九版诊断学P363）（ALP）主要分布在肝脏、骨骼、肾、小肠及胎盘中，正常血清中的碱性磷酸酶主要来自骨骼，由成骨细胞产生，骨肉瘤患者的骨细胞成骨、溶骨活动增强，可引起ALP显著增高（A对）。癌胚抗原（九版诊断学P417）（B错）升高主要见于胰腺癌、结直肠癌等。乳酸脱氢酶（LDH）（C错）以心肌、骨骼肌和肾脏含量最丰富，骨肉瘤患者血清中乳酸脱氢酶含量增高不明显。α-酸性糖蛋白（AAG）（D错）是主要的急性时相反应蛋白，在急性炎症时增高，与免疫防御功能有关。胚胎抗原（E错）升高主要见于肝细胞癌、结肠癌等恶性肿瘤，但骨肉瘤时胚胎抗原不升高。